《中国药典》规定，应测定梓醇含量的饮片是
A. 牛膝
B. 白芷
C. 延胡索
D. 生地黄
E. 制何首乌

正确答案：D。生地黄

解析：本题考查生地黄的含量测定。《中国药典》规定，应测定梓醇含量的饮片是生地黄（D对）。生地黄【含量测定】按《中国药典》采用高效液相色谱法测定，生地黄含梓醇不得少于0.20%，含毛蕊花糖苷不得少于0.020%。牛膝（A错）【含量测定】按《中国药典》采用高效液相色谱法测定，含β-蜕皮甾酮不得少于0.030%。白芷（B错）【含量测定】按《中国药典》采用高效液相色谱法测定，本品含欧前胡素不得少于0.080%。延胡索（C错）【含量测定】按《中国药典》采用高效液相色谱法测定，本品含延胡索乙素不得少于0.050%；饮片不得少于0.040%。制何首乌（E错）【含量测定】按《中国药典》采用高效液相色谱法测定，本品含2,3,5,4'-四羟基二苯乙烯-2-O-β-D-葡萄糖苷不得少于1.0%，含结合蒽醌以大黄素和大黄素甲醚的总量计，不得少于0.10%；饮片含结合蒽醌不得少于0.05%。